患者胃痛暴作，恶寒喜暖，脘腹得温则痛减，口不渴，喜热饮，舌苔薄白，脉弦紧。治疗应首选
A. 藿朴夏苓汤
B. 桂枝汤
C. 小建中汤
D. 黄芪建中汤
E. 良附丸

正确答案：E。良附丸

解析：题中患者以胃痛暴作胃主症，故诊断为胃痛。胃痛暴作为外感寒邪，客于胃腑，导致胃气壅滞，失于通降所致。寒为阴邪，故恶寒喜暖，脘腹得温则痛减；寒凝胃脘，阳气被遏，但津液未伤，故口不渴，喜热饮；舌苔薄白，脉弦紧为寒邪之象，故辨为寒邪客胃证，治宜温胃散寒，行气止痛。藿朴夏苓汤功能解表化湿，主治湿温初起，身热恶寒，肢体倦怠，胸闷口腻者（A错）。桂枝汤功能解肌发表，调和营卫，主治外感风寒表虚证（B错）。小建中汤功能温中补虚，缓急止痛，为腹痛中脏虚寒证的选方（C错）。黄芪建中汤功能温中散寒，和胃止痛，为胃痛脾胃虚寒证的选方（D错）。题中辨为胃痛寒邪客胃证，治宜温胃散寒，行气止痛，首选良附丸合香苏散（E对）。